以下关于克里斯坦森Christensen现象的描述，哪一项不对
A. 克里斯坦森现象出现于髁道斜度呈正度数时
B. 克里斯坦森现象是确定前伸髁道斜度的基础
C. 克里斯坦森现象出现在后牙区，呈前小后大的间隙
D. 克里斯坦森现象出现在后牙区，呈前大后小的间隙
E. 由于有克里斯坦森现象，所以可以取前伸颌蜡记录

正确答案：D。克里斯坦森现象出现在后牙区，呈前大后小的间隙

解析：本题考查克里斯坦森现象。以下关于克里斯坦森Chiristensen现象的描述，克里斯坦森出现于后牙区，出现为前大后小的间隙（D错，为本题的正确答案）不对。克里斯坦森现象：上下颌（牙合）托戴人口内后，嘱患者下颌向前伸约6mm，当下颌（牙合）托向上颌（牙合）托闭合时，（牙合）托前缘接触，而后部离开，形成楔形间隙；此间隙出现于髁道斜度呈正度数时，正度数越大，楔状间隙也越大。前伸（牙合）髁道斜度的测定法是由Christensen发现的。根据克里斯坦森现象，将烤软的叠成三层的蜡片，形成马掌形，置于下颌（牙合）托（牙合）平面上，嘱患者前伸下颌约6mm时，轻轻咬住（牙合）托，冲以冷水使蜡记录变硬。取出，上下颌（牙合）托及蜡记录，从后面将上颌（牙合）托撬离蜡记录。上下颌（牙合）托分别就位于（牙合）架上，注意先松开正中锁和固定髁槽的螺丝。将上颌（牙合）托对在蜡记录上面。前后搬动固定髁槽的螺丝，当上颌（牙合）托（牙合）平面与蜡记录完全接触时，此时前伸髁导斜度就是患者的髁道斜度。扭紧螺丝固定髁槽，取下蜡记录，将髁球固定在紧贴髁槽前壁的位置，这样就完成了前伸髁导斜度的确定工作。为了减少误差，通常要作3次前伸（牙合）关系记录，将3次中比较接近的2次的均数作为前伸髁导斜度。综上所述，克里斯坦森现象出现于髁导斜度正度数时（A对）、克里斯坦森现象是确定前伸髁导斜度的基础（B对）、克里斯坦森现象出现于后牙区，出现为前小后大的间隙（C对）、由于克里斯坦森现象，所以可以取前伸蜡（牙合）记录（E对）均为对克里斯坦森现象的正确描述。